苍术具有的功效是
A. 消积平喘
B. 利水消肿
C. 行气止呕
D. 燥湿健脾
E. 温中截疟

正确答案：D。燥湿健脾

解析：苍术药性辛，苦，温。归脾、胃、肝经。苦温燥湿以祛湿浊，辛香健脾以和脾胃。辛散苦燥，长于祛湿，故痹证湿胜者尤宜。辛香燥烈，能开肌腠而发汗，祛肌表之风寒表邪，又因其长于胜湿，故以风寒表证挟湿者最为适宜。能明目，用于夜盲症，眼目昏涩。功效是燥湿健脾（D对），祛风散寒，明目。厚朴的功效是燥湿化痰，消积平喘（A错）。香加皮的功效是祛风湿，强筋骨，利水消肿（B错）。豆蔻的功效是温中化湿，行气止呕（C错）。草果的功效是燥湿除痰，温中截疟（E错）。